某男，65岁。患高血压及原发性高脂血症，症见头痛、眩晕、急躁易怒、心悸、失眠。证属肝阳上亢，宜选用的中成药是
A. 正天胶囊
B. 芎菊上清丸
C. 川芎茶调口服液
D. 松龄血脉康胶囊
E. 杞菊地黄口服液

正确答案：D。松龄血脉康胶囊

解析：本题考查的是松龄血脉康胶囊的主治。患高血压及原发性高脂血症，症见头痛、眩晕、急躁易怒、心悸、失眠。证属肝阳上亢，宜选用的中成药是松龄血脉康胶囊（D对）。松龄血脉康胶囊：【主治】肝阳上亢所致的头痛、眩晕、急躁易怒、心悸、失眠；高血压及原发性高脂血症见上述证候者。正天胶囊（A错）：【主治】外感风邪、瘀血阻络、血虚失养、肝阳上亢引起的偏头痛、紧张性头痛、神经性头痛、颈椎病型头痛、经前头痛。芎菊上清丸（B错）：【主治】外感风邪引起的恶风身热、偏正头痛、鼻流清涕、牙疼喉痛。川芎茶调口服液（C错）：【主治】外感风邪所致的头痛，或有恶寒、发热、鼻塞。杞菊地黄口服液（E错）：【主治】肝肾阴亏，眩晕耳鸣，羞明畏光，迎风流泪，视物昏花。